女性，58岁患者。因发热、咳嗽、胸闷、气短1周收入住院。查体：T37.5℃，R24次/分，口唇发绀。双下肺叩诊呈浊音、语颤明显减弱、呼吸音消失。腹部隆起，叩诊移动性浊音（+）。双侧胸液、腹水呈乳糜样，苏丹染色阴性。胸液腹液常规均示渗出液，淋巴细胞为主，LDH1200U/L，CEA明显增高。PPD（+）。最可能的诊断是
A. 化脓性胸膜炎
B. 结核性胸膜炎
C. 恶性胸腔积液
D. 乳糜样胸腔积液
E. 结缔组织疾病

正确答案：C。恶性胸腔积液

解析：患者近1周出现发热、咳嗽、胸闷、气短，胸水检查提示以淋巴细胞为主，LDH1200U/L，CEA明显增高，根据其临床表现和辅助检查，考虑恶性胸腔积液（C对）。化脓性胸膜炎（A错）患者胸水中白细胞常升高，以中性粒细胞增多为主，且CEA不会明显升高。结核性胸膜炎（B错）患者胸水中ADA（腺苷脱氨酶）多升高，本例无低热、盗汗等结核中毒症状，虽然PPD（+），但是PPD试验仅对儿童、少年和青年的结核病诊断有参考意义，故仍可排除结核性胸膜炎。乳糜样胸腔积液（D错）多见于胸导管破裂，苏丹Ⅲ染色阳性。结缔组织疾病（E错）也可导致胸腔积液，但本例并没有结缔组织病的相关表现，如晨僵、关节痛等。